颈髓病变时会出现上肢椎体束征，也称为
A. Gordon（戈登氏征）
B. Hoffmann（霍夫曼征）
C. Chaddock（查多克征）
D. Babinski（巴彬斯基征）
E. Oppenheim（奥本海姆征）

正确答案：B。Hoffmann（霍夫曼征）

解析：Hoffmann（霍夫曼征）（B对）检查时，检查者用左手轻握被检者腕部，以右手食指及中指轻夹病人中指末端指节，并使腕关节略背屈，各手指轻度屈曲，以拇指迅速向下弹刮被检者中指指甲，正常时无反应，如拇指内收，其余手指也呈屈曲动作即为阳性反应。霍夫曼征阳性属于一种神经病理反射，它代表上肢锥体束症（损伤或病变），常见于脑血管疾病等，也可见于颈椎病变，如双侧霍夫曼氏征阳性，而无神经系统体征则无定位意义。Babinski（巴宾斯基征）（D错）、Oppenheim（奥本海姆征）（E错）、Gordon（戈登征）（A错）、Chaddock（查多克征）（C错）均指锥体束病损时，大脑失去了对脑干和脊髓的抑制作用而出现的病理反射，阳性常提示有锥体束受损，1岁半以内的婴幼儿因神经系统发育未完善，也可以出现这些反射，不属于病理性。